产后感染邪毒发热的主要证候中，下列哪一项是错误的
A. 高热寒战
B. 小腹疼痛拒按
C. 恶露色暗如败酱
D. 口干不欲饮
E. 舌红苔黄，脉数

正确答案：D。口干不欲饮

解析：产褥感染感染邪毒证证候为高热寒战（A对），小腹疼痛拒按（B对），恶露色暗如败酱（C对），舌红苔黄，脉数（E对），没有口干不欲饮的症状（D错，为本题正确答案）。